肾蒂中位于最后方的是
A. 肾盂
B. 肾静脉
C. 肾动脉
D. 肾乳头
E. 肾柱

正确答案：A。肾盂

解析：肾蒂中位于最后方的是肾盂（A对）。